在分子中引入可增强与受体的结合力，增加水溶性，改变生物活性的基团是
A. 卤素
B. 羟基
C. 硫醚
D. 酰胺基
E. 烷基

正确答案：B。羟基

解析：本题考查药物结构中的取代基对生物活性影响。在分子中引入可增强与受体的结合力，增加水溶性，改变生物活性的基团是羟基（B对）。卤素（A错）属于强吸电子基，可增加脂溶性，延长作用时间。硫醚（C错）含有孤对电子、在体内可氧化成亚砜或砜。酰胺（D错）可与生物大分子形成氢键，增强与受体的结合能力。